在医疗行为中良心的重要作用不包括的是
A. 医疗行为之前的选择作用
B. 医疗行为之中的监督作用
C. 医疗行为之中的判断作用
D. 医疗行为之后的评价作用
E. 医疗行为之后的激励作用

正确答案：C。医疗行为之中的判断作用

解析：一个有良心的医务人员，如果看到自己的行为符合医学道德要求，便会因自己做一个好人的道德需要得到满足和实现而感到快乐，沉浸在良心满足的喜悦之中；相反，如果看到自己的行为不符合医学道德要求，便会因做一个好人的道德需要就没有得到满足和实现而感到内疚，便会遭受良心谴责的痛苦折磨。良心能够促使医务人员遵守医学道德规范。医疗行为中良心的重要作用包括的是医疗行为之前的选择作用、医疗行为之中的监督作用、医疗行为之后的评价作用、医疗行为之后的激励作用（C错，为本题正确答案）。